在突发环境污染事件的应急监测中，其采样频次的确定原则不包括
A. 以最低的采样频次，求得最有代表性的样品
B. 既能确切反映污染程度、范围、消减情况，又切实可行
C. 事故刚刚发生不久，采样频次要密
D. 待摸清变化、消减规律后，可减少采样频次
E. 每一个小时采样1次

正确答案：E。每一个小时采样1次

解析：本题考查在突发环境污染事件的应急监测中，采样频次的确定原则。在突发环境污染事件的应急监测中，依照不同的环境区域功能和突发环境污染事件发生地的实际情况，按以下原则决定采样频次：①力求以最低的采样频次（E错，为本题正确答案），求得最有代表性的样品（A对）；②既能确切反映污染程度、范围、消减情况，又切实可行（B对）；③在事故刚发生时，采样频次宜密（C对），待摸清变化、消减规律后，可减少采样频次（D对）。